对α受体和β受体均有强大的激动作用的是
A. 去甲肾上腺素
B. 多巴胺
C. 可乐定
D. 肾上腺素
E. 多巴酚丁胺

正确答案：D。肾上腺素

解析：α、β肾上腺素受体激动药有：肾上腺素等。肾上腺素：①兴奋心脏：作用于心肌、传导系统和窦房结的β₁β₂受体，加强心肌收缩力。②收缩血管：主要影响小动脉及毛细血管前括约肌，同时激动血管上的α₁和β₂受体，分别产生缩血管及扩血管作用。③舒张平滑肌：动支气管平滑肌的β₂受体而使支气管平滑肌舒张；还可激动支气管黏膜血管的α受体。④促进代谢：体内由于α受体和 β.受体兴奋都可使肝糖原分解，而肾上腺素兼具α、β作用（D对）。